下列各项，易导致妇产科疾病发生的是
A. 风、寒、湿
B. 风、湿、热
C. 寒、热、湿
D. 寒、暑、热
E. 寒、湿、燥

正确答案：C。寒、热、湿

解析：寒热湿邪易与血相搏而发生妇产科病，寒性收引，主凝滞，易使气血阻滞不通。外寒是寒邪由外及里，伤及肌表、经络、血脉或经期，寒邪由阴户上客，入侵子宫进而产生妇科病。内寒，阳气的温煦和气化功能减退，常导致闭经、痛经等；热邪易耗气伤津，损伤正气，津液亏乏，热迫血行，故出现出血之症；湿性粘滞，患部重着，病情缠绵，湿留在体内日久，又可随体质的阴阳盛衰而产生寒化或热化，导致带下、盆腔炎等（C对）。